吸收到体内的外源性物质的原形或其代谢产物的含量称为
A. 内剂量
B. 生物效应剂量
C. 易感性标志物
D. 接触性生物标志物
E. 效应性生物标志物

正确答案：A。内剂量